患儿，女，3岁，1天前被蚊子叮咬后右侧小臂出现直径约1cm红色丘疹，涂抹治疗蚊虫叮咬的药膏后，症状无缓解且肿胀加重，患儿母亲前来咨询。下列药师所给出的建议中，错误的是
A. 可局部热敷以加速丘疹消退
B. 可用炉甘石洗剂摇匀后涂于患处，每日3次
C. 可用适量丁酸氢化可的松乳膏涂于患处，每日2次
D. 如瘙痒或肿胀严重，可口服氯雷他定糖浆，每晚1次
E. 如经以上对症处理后症状仍未缓解，建议就诊

正确答案：A。可局部热敷以加速丘疹消退

解析：本题考查昆虫叮咬的药物治疗。治疗原则：适当选择外用止痒、消肿药物；中度患者加服抗组胺药物；重度患者可口服糖皮质激素；如出现继发感染者给予抗菌药物治疗。1.局部治疗：炉甘石洗剂混匀后取适量涂抹于患处，每日3次（B对）。丁酸氢化可的松乳膏，每日2次（C对）。2.口服抗组胺药物如氯苯那敏、西替利嗪、氯雷他定（D对）。3.肾上腺糖皮质激素泼尼松15～20mg/d口服，逐渐减量。4.合并感染时可给予抗菌药物。5.局部冷湿敷可加速皮疹消退（D错，为本题正确答案）。